复发性疱疹性口炎一般复发感染的部位是
A. 舌背
B. 舌腹面
C. 软腭
D. 口唇或接近口唇处
E. 颊部

正确答案：D。口唇或接近口唇处

解析：一般复发感染的部位在口唇或接近口唇处，故又称复发性唇疱疹。复发的口唇损害有两个特征：①损害总是以起疱开始，常为多个成簇的疱，单个的疱较少见。②损害复发时，总是在原先发作过的位置，或邻近原先发作过的位置。掌握“口腔单纯疱疹”知识点。